伸直型桡骨下端骨折的畸形是
A. 垂腕型
B. 银叉型
C. 尺偏型
D. 爪型
E. 僵硬型

正确答案：B。银叉型

解析：伸直型桡骨下端骨折即Colles骨折，由于骨折远端向桡、背侧移位，近端向掌侧移位，其可出现典型的畸形体征，侧面观呈“银叉”畸形（B对），正面观呈“枪刺样”。“垂腕”畸形（A错）见于桡神经损伤。“爪形手”畸形（D错）可见于尺神经损伤。僵硬型（E错）、尺偏型（C错）不是桡骨骨折的典型表现。